患者。女性，45岁，近日自觉口腔干燥、味觉异常，口腔黏膜充血糜烂及舌背乳头成团块状萎缩，周围舌苔增厚。半月前刚结束肿瘤化疗。下列诊断正确的是
A. 疱疹样口疮
B. 药物过敏性口炎
C. 口腔单纯疱疹
D. 天疱疮
E. 念珠菌口炎

正确答案：E。念珠菌口炎

解析：念珠菌口炎临床表现为黏膜上出现外形弥散的红斑，以舌黏膜多见，严重时舌背黏膜呈鲜红色并有舌乳头萎缩，双颊、上腭及口角也可有红色斑块。黏膜红斑是由于上皮萎缩加上黏膜充血所致，因此，近年来有学者认为该型以红斑型取代以前命名的萎缩型较为合理。若继发于假膜型，则可见假膜。自觉症状为口干、味觉异常、疼痛及烧灼感。掌握“口腔念珠菌病”知识点。